同时具有短效和长效（双时相）作用的胰岛素/胰岛素类似物是
A. 普通胰岛素注射液
B. 精蛋白锌胰岛素注射液
C. 预混胰岛素注射液
D. 甘精胰岛素注射液
E. 低精蛋白锌胰岛素注射液

正确答案：C。预混胰岛素注射液

解析：本题考查岛素及胰岛素类似物的分类。预混胰岛素注射液（C对）是指含有两种胰岛素的混合物，可同时具有短效和长效胰岛素的作用。普通胰岛素注射液（A错）属于短效胰岛素。精蛋白锌胰岛素注射液（B错）属于长效胰岛素。甘精胰岛素注射液（D错）属于长效胰岛素。低精蛋白锌胰岛素注射液（E错）属于长效胰岛素。